乙型脑炎（简称乙脑）的主要传染源是
A. 猪
B. 乙脑病毒携带者
C. 乙脑患者
D. 蚊虫
E. 野鼠

正确答案：A。猪

解析：猪（A对）的乙脑感染率高，感染后血中病毒含量多，病毒血症期长，且猪的饲养面广，更新率快，是本病的主要传染源；人感染后病毒血症期短暂，血中病毒含量少，故乙脑携带者（B错）和乙脑患者（C错）不是主要的传染源；蚊虫（D错）是乙脑病毒的长期储存宿主，可带病毒越冬，但不是主要传染源，蚊虫叮咬是乙脑的主要传播途径；传染源主要为倍感染的家畜、家禽和鸟类，不包括野鼠（E错）。